患者，男，68岁，既往有高血压，双侧肾动脉狭窄，因水肿复诊，体检和实验室检查，血压172/96mmHg，尿蛋白大于2g/24h（正常值＜150mg/24h），血尿酸416㎛ol/L（正常值180～440㎛ol/L），血钾6.1mmol/L（正常值3.5～5.5mmmol/L）。在已经服用氨氯地平的基础上，应考虑联合应用的抗高血压药是
A. 螺内酯
B. 依那普利
C. 卡托普利
D. 呋塞米
E. 拉西地平

正确答案：D。呋塞米

解析：本题考查呋塞米。呋塞米（D对）为袢利尿剂，作用于髓袢升支粗段的Na⁺-K⁺-2Cl⁻同向协转运系统，促进Na⁺、K⁺、Cl⁻排泄。用于高血压时效果虽不如噻嗪类利尿药，但对高钾血症效果较好。螺内酯（A错）是醛固酮的竞争性抑制剂，会升高血钾，而此患者的血钾本来就高，因此不选用。依那普利（B错）和卡托普利（C错）为血管紧张素转换酶抑制剂，双侧肾狭窄者禁用。拉西地平（E错）与氨氯地平一样都是钙通道阻滞剂类降压药，因为已经选用了氨氯地平，故不选用拉西地平。